会同同级药品监督管理部门制定个体诊所急救药品的品种和范围的是
A. 国务院药品监督管理部门
B. 省级药品监督管理部门
C. 设区的市级药品监督管理机构
D. 省级卫生行政部门
E. 国家中医药管理局

正确答案：D。省级卫生行政部门